分层分析可以控制
A. 选择偏倚
B. 信息偏倚
C. 混杂偏倚
D. Berkson偏倚
E. 检出症候偏倚

正确答案：C。混杂偏倚

解析：本题考查分层分析可以控制的偏倚。分层分析是根据潜在混杂因素的有无或程度将研究对象分为不同的层，然后在各层中比较病例组和对照组暴露因素的分布。在资料分析阶段，可采取分层分析方法控制混杂偏倚（C对ABDE错）。